大部分毒物的吸收方式是
A. 滤过
B. 主动转运
C. 被动转运
D. 膜动转运

正确答案：C。被动转运

解析：本题考查大部分毒物的吸收方式。被动转运为化学毒物顺浓度差通过生物膜的过程。被动转运（C对ABD错）是大部分毒物的吸收方式，包括简单扩散和滤过。